患者，女，30岁，孕妇20周，主诉粪便干硬，排便困难，诊断为便秘，现拟进行药物治疗，该患者宜选用的便秘治疗药是
A. 番泻叶
B. 聚卡波非钙
C. 普芦卡必利
D. 利那洛肽
E. 比沙可啶

正确答案：B。聚卡波非钙

解析：本题考查容积性泻药。容积性泻药通过滞留粪便中的水分，增加粪便含水量和粪便体积起到通便作用，常用药物包括欧车前、聚卡波非钙（B对）和麦麸等。